知饥不食、舌红少苔常见于
A. 胃气虚证
B. 胃热证
C. 肝胃不和证
D. 胃阴虚证
E. 食滞胃脘证

正确答案：D。胃阴虚证

解析：本题考查的是胃阴虚证的临床表现。知饥不食、舌红少苔常见于胃阴虚证（D对）。胃阴虚证的临床表现，常见口咽发干，多以睡后明显，不思饮食，或知饥不食，并有心烦、低热、大便不调、干呕作呃，舌红少苔或无苔，脉细数。胃热证（B错）的临床表现，常见胃脘灼热而疼痛，烦渴多饮或渴欲冷饮，消谷善饥，牙龈肿痛，口臭，泛酸嘈杂，舌红苔黄，脉滑数。肝胃不和证（C错）的临床表现，常见胸胁胀满，善太息，胃脘胀满作痛，嗳气吞酸，嘈杂或呕恶，苔薄黄，脉弦。食滞胃脘证（E错）的临床表现，常见脘腹胀满，呕吐酸腐，嗳气反酸，或矢气酸臭，不思饮食，大便泄泻或秘结。舌苔厚腻，脉滑。胃气虚证（A错）的临床表现，2022年考试指南未明确说明。